定经汤适用于
A. 月经后期，血寒证
B. 月经后期，虚寒证
C. 月经先后无定期，肝郁证
D. 月经先后无定期，肾虚证
E. 月经先后无定期，肾虚肝郁证

正确答案：E。月经先后无定期，肾虚肝郁证

解析：月经先后无定期肾虚肝郁证的病机是肝肾功能失常，冲任失调，血海蓄溢无常；定经汤功效为舒肝补肾，养血调经；契合病机（E对）。艾附暖宫丸主治月经后期，虚寒证（B错）。月经后期，血寒证（A错）方药温经汤；月经先后无定期，肝郁证（C错）方宜逍遥散；月经先后无定期，肾虚证（D错）治宜固阴煎；